终末期慢性肾衰竭的最主要死亡原因是
A. 心脑血管并发症
B. 严重感染
C. 严重电解质紊乱
D. 尿毒症脑病
E. 消化道大出血

正确答案：A。心脑血管并发症

解析：心脑血管并发症（A对）是终末期慢性肾衰竭的最主要死亡原因。严重感染（B错）、严重电解质紊乱（C错）、尿毒症脑病（D错）、消化道大出血（E错）均可见于终末期慢性肾衰竭，并且具有致死性，但均不是终末期慢性肾衰竭的最主要死亡原因。